材料七：A县药品稽查人员在该县的一村卫生室进行监督检查，现场查获标示为B省的大众生物科技有限公司生产的金银花百合片和乌梢蛇桔梗胶囊等8种产品，共计6000盒，这些产品在标签上或说明书中标注了适应症或功能主治，明示了治疗功效和用法用量，但未标示药品批准文号。A县公安局经立案侦查发现，B省的大众生物科技有限公司是两年前开办的新企业，没有药品生产许可证和药品经营许可证，法定代表人是刘某。刘某组织人员在居民楼生产假药，经过网络和快递物流进行销售，并通过银行卡收取货款。同时，刘某雇了王某、黄某和周某分别将上述产品提供给A县几个村卫生室，供就诊患者使用。村卫生室医师张某在近半年内分批分次销售给患者。关于B省大众生物科技有限公司涉嫌产品和行为的定性，正确的是
A. 涉嫌无证生产经营，涉事产品为劣药
B. 涉嫌伪造变造许可证，涉事产品为假药
C. 涉嫌无证生产经营，涉事产品为假药
D. 涉嫌无证经营，涉事产品为劣药

正确答案：C。涉嫌无证生产经营，涉事产品为假药

解析：本题考查药品经营管理。没有药品生产许可证和药品经营许可证属于无证经营，未经批准生产的药品则按假药论处（C对）。